某小学校160名学生，在饭店定做课间餐，学生在当天上午8:50～9:00食用，大约3小时后，其中有79人出现头晕、腹痛、腹泻、恶心、呕吐。腹泻主要是黄绿色水样便，每日数次至10余次。腹痛多在上腹部，伴有压痛，体温一般在38～40℃。其发病可能的原因是
A. 蛋类被污染
B. 家畜、家禽肉类被污染
C. 奶类被污染
D. 熟制品被污染
E. 以上都是

正确答案：E。以上都是